颌面部晚期梅毒在口腔中表现为树胶样肿，最常见于口腔什么部位
A. 下颌角
B. 上颌牙龈
C. 鼻中隔
D. 颧骨
E. 硬腭

正确答案：E。硬腭

解析：梅毒树胶样肿除累及软组织外，还可累及颌面骨及骨膜组织。以硬腭部最常见，其次为上颌切牙牙槽突、鼻中隔。间或可见于颧骨、下颌角部。掌握“颌面部梅毒”知识点。